患者，男，58岁，有高血压、冠心病、高脂症、便秘、骨关节炎和胃溃疡病史，2年前接受冠脉支架植入术。近日，患者先后在心内科、消化科、骨科就诊，开具药品如下：酒石酸美托洛尔片、阿司匹林肠溶片、单硝酸异山梨酯片、阿托伐他汀钙片、聚乙二醇4000散、双氯芬酸钠缓释片、奥美拉唑肠溶片、麝香保心丸和复方丹参片。关于该患者使用阿司匹林的说法，正确的是
A. 阿司匹林属于冠心病一级预防，长期使用方可获益
B. 阿可匹林用药期间，需定期监测INR
C. 用药期间，应关注腹痛、柏油样便或呕血等消化道出血症状
D. 阿司匹林肠溶片在进餐时服用，以减轻对胃肠道的刺激性
E. 阿司匹林不耐受时，可换用替格瑞洛进行长期抗血小板治疗

正确答案：C。用药期间，应关注腹痛、柏油样便或呕血等消化道出血症状

解析：本题考查阿司匹林。阿司匹林用药期间，应关注腹痛、柏油样便或呕血等消化道出血症状（C对）。阿司匹林为水杨酸类解热镇痛药，胃肠道症状是其最常见的不良反应。冠心病二级预防时（A错），阿司匹林肠溶片的最佳剂量范围为75～150mg/d。不能耐受阿司匹林的患者可改用氯吡格雷作为替代治疗。目前尚无指南推荐替格瑞洛可用于替代阿司匹林（E错）。目前INR测定主要用于维生素K拮抗剂（如华法林）抗凝效果的监测（B错）。阿司匹林肠溶片要整片用温水吞服，最好是空腹服用（D错）。